下列属于宏量元素的是
A. 钙
B. 铁
C. 锌
D. 硒
E. 碘

正确答案：A。钙